胆碱酯酶复活剂对各类有机磷杀虫药中毒的疗效不尽相同，对下列哪项中毒疗效好
A. 乐果
B. 3911
C. 敌百虫
D. 敌敌畏
E. 谷硫磷

正确答案：B。3911

解析：胆碱酯酶复活剂对3911中毒疗效好，3911是剧毒性有机磷农药（B对）。